对药物结构中氨基进行成酰胺修饰不能达到的目的是
A. 增加药物的组织选择性
B. 降低毒副作用
C. 延长药物作用时间
D. 降低脂溶性
E. 增加药物的稳定性

正确答案：D。降低脂溶性